高容量性低钠血症的特点是
A. 血清Na⁺浓度﹤130mmol/L
B. 血浆渗透压﹤280mmol/L
C. 体钠总量正常或增多
D. 体液量明显增多
E. 以上都是

正确答案：E。以上都是

解析：水中毒为各种原因所致的过多的低渗性体液在体内潴留造成细胞内外液量都增多（D对），血清Na＋浓度<135mmol/L（A对），血浆渗透压<290mmol/L（B对），但体钠总量正常或增多（C对，故E为本题正确答案）。